剂量反应关系曲线有
A. 直线型曲线
B. 抛物线型曲线
C. 对称S状曲线
D. 非对称S状曲线
E. 以上都是

正确答案：E。以上都是